影响污染物对人体作用的因素是
A. 污染物的理化特性
B. 剂量
C. 作用持续时间
D. 个体感受性
E. 以上都是

正确答案：E。以上都是

解析：本题考查影响污染物对人体作用的因素。影响污染物对人体作用的因素有污染物的理化特性、剂量、作用持续时间和个体感受性（E对ABCD错）。